深龋的症状
A. 激发痛
B. 自发剧痛
C. 两者皆有
D. 两者皆无

正确答案：A。激发痛

解析：本题考查深龋的症状。龋病进展到牙本质深层为深龋，此时病变已接近牙髓，因此冷热刺激或食物进入窝洞时，容易刺激牙髓，出现激发痛（A对）。自发剧痛（B错）是急性牙髓炎的症状，深龋牙髓活力基本正常没有自发剧痛。综上深龋有激发痛没有自发痛（CD错）。